肱骨外科颈骨折是
A. 肱骨大、小结节交界处
B. 肱骨大小结节移行为肱骨干的交界处
C. 肱骨头周围的环形沟
D. 肱骨头与肱骨干的交界处
E. 肱骨上端干骺端处

正确答案：B。肱骨大小结节移行为肱骨干的交界处

解析：肱骨外科颈指肱骨大结节、小结节移行为肱骨干的交界处（B对），为松质骨和密质骨的交接处，易发生骨折。肱骨头周围环型沟（C错）为解剖颈。肱骨大、小结节交界处（A错）的纵形浅沟称为结节间沟，其中有肱二头肌长头腱通过。肱骨头与肱骨干的交界处（D错）、肱骨上端干骺端处（E错）无特殊意义。